镇静药引起嗜睡，醒觉时仍有宿醉感，属于
A. 副作用
B. 毒性反应
C. 后遗效应
D. 继发反应
E. 首剂效应

正确答案：C。后遗效应

解析：本题考查药品的不良反应。镇静药引起嗜睡，醒觉时仍有宿醉感，属于后遗效应（C对）。后遗效应是指在停药后，血药浓度已降至最小有效浓度以下时残存的药理效应。例如，服用巴比妥类催眠药后，次晨出现的乏力、困倦等“宿醉”现象；长期应用肾上腺皮质激素，可引起肾上腺皮质萎缩，一旦停药，可出现肾上腺皮质功能低下，数月难以恢复。副作用（A错）是指在药物按正常用法用量使用时，出现的与治疗目的无关的不适反应。毒性作用（B错）是指在药物剂量过大或体内蓄积过多时发生的危害机体的反应。继发反应（D错）是由于药物的治疗作用所引起的不良反应。首剂效应（E错）是指一些患者在初服某种药物时，由于机体对药物作用尚未适应而引起不可耐受的强烈反应。例如哌唑嗪等按照常规剂量开始治疗常可致血压骤降。